肺炎球菌肺炎患者若对青霉素过敏，宜选用的有效抗菌药物是
A. 庆大霉素
B. 阿米卡星
C. 链霉素
D. 左氧氟沙星
E. 阿莫西林

正确答案：D。左氧氟沙星

解析：肺炎球菌肺炎治疗首选青霉素，若对青霉素过敏，宜选用氟喹诺酮类（左氧氟沙星）（D对）、头孢噻肟或头孢曲松类药物。庆大霉素（A错）、阿米卡星（B错）、链霉素（C错）均是氨基糖苷类抗生素，主要用于革兰阴性杆菌的治疗，肺炎链球菌为革兰阳性球菌。阿莫西林（E错）是广谱青霉素类，禁用于青霉素过敏者。